奥美拉唑抑制胃酸分泌的机制是
A. 阻断H2受体
B. 抑制胃壁细胞H+泵的功能
C. 阻断M受体
D. 阻断胃泌素受体
E. 直接抑制胃酸分泌

正确答案：B。抑制胃壁细胞H+泵的功能

解析：奥美拉唑有强大持久的抑制胃酸分泌作用。抑制胃酸作用持久，连续服用的效果优于单次服用。由于胃内pH升高，反馈性地使血中胃泌素水平升高。但由于本药对组胺，五肽胃泌素等刺激引起的胃酸分泌亦有明显抑制作用，所以并不影响其抑制胃酸分泌作用。动物实验证明对胃黏膜损伤有预防保护作用。体外试验证明有抗幽门螺杆菌作用。临床用于治疗溃疡病。掌握“奥美拉唑”知识点。